只需极低浓度既可激活多克隆T细胞的物质是
A. 自身抗原
B. 同种异型抗原
C. 超抗原
D. 独特型抗原
E. 异嗜性抗原

正确答案：C。超抗原